重度主动脉瓣返流时心尖部可存在
A. Graham-Steell杂音
B. Austin-Flint杂音
C. Durozier征
D. Traube征
E. DeMusset征

正确答案：B。Austin-Flint杂音

解析：主动脉瓣反流明显者，导致左心室舒张期容量负荷过高，使二尖瓣基本处于半关闭状态，呈现相对狭窄而产生的杂音，称Austin-Flint杂音（B对）。二尖瓣严重狭窄时，产生肺淤血，致严重肺动脉高压，肺动脉扩张，造成相对性肺动脉瓣关闭不全，产生Graham-Steell杂音（P167）（A错）。Durozier征（C错）、Traube征（D错）、DeMusset征（点头征）（E错）为周围血管征，出现于脉压增加或血液量增加时，不存在于心尖部。